胸骨右缘第二肋间触及收缩期震颤，最常见于
A. 三尖瓣狭窄
B. 肺动脉瓣狭窄
C. 二尖瓣狭窄
D. 室间隔缺损
E. 主动脉瓣狭窄

正确答案：E。主动脉瓣狭窄

解析：震颤为触诊时手掌尺侧（小鱼际）或手指指腹感到的一种细小震动感。震颤的发生机制与心杂音相同，系血液经狭窄的口径或循环异常的方向流动形成涡流造成瓣膜、血管壁或心脏壁震动传至胸壁所致。发现震颤后应首先确定部位及来源，其次确定其处于心动周期中的时期，最后分析其临床意义。胸骨右缘第二肋间触及收缩期震颤（E对），最常见于主动脉瓣狭窄。三尖瓣狭窄（A错）时，胸骨左缘第4肋间可闻收缩期前或舒张期滚筒样杂音，有时可触及震颤。肺动脉瓣狭窄（B错）时，可于胸骨左缘第二肋间触及收缩期杂音。二尖瓣狭窄（C错）时，可以心尖区触及舒张期震颤。室间隔缺损（D错）时，可于胸骨左缘第三、四肋间闻及收缩期杂音。